人体重复用药引起的身体对药物反应性下降属于
A. 身体依赖性
B. 药物敏化现象
C. 药物滥用
D. 药物耐受性
E. 抗药性

正确答案：D。药物耐受性

解析：本题考查药物滥用与药物依赖性。人体重复用药引起的身体对药物反应性下降属于药物耐受性（D对）。药物耐受性是指在连续用药过程中，有的药物的药效会逐渐减弱，需加大剂量才能显效的现象。身体依赖性（A错）是指中枢神经系统对长期使用的药物所产生的一种身体适应状态；一旦停药，将发生一系列生理功能紊乱，称为戒断综合征。药物敏化现象（B错）是药物使另一药物对其作用部位的亲和力和敏感性增强的现象。药物滥用（C错）是指非医疗目的地使用具有致依赖性潜能的精神活性物质的行为。抗药性（E错）又称耐药性，系指在化学治疗中，病原体或肿瘤细胞对化疗药物的敏感性降低的现象。